支气管哮喘的典型临床表现是
A. 呼气性呼吸困难
B. 吸气性呼吸困难
C. 混合性呼吸困难
D. 劳力性呼吸困难
E. 夜间阵发性呼吸困难

正确答案：A。呼气性呼吸困难

解析：支气管哮喘发作时小气道发生慢性炎症、高反应性、重构等变化，造成小气道狭窄，故支气管哮喘的典型临床表现是呼气性呼吸困难（A对）。吸气性呼吸困难（B错）见于大气道狭窄、梗阻，如中央型肺癌、支气管异物等。混合性呼吸困难（C错）多见于重症肺炎、自发性气胸、胸膜炎、大面积肺栓塞等。劳力性呼吸困难（D错）见于慢性阻塞性肺疾病、慢性心力衰竭等。夜间阵发性呼吸困难（E错）主要见于左心衰竭。